某女，35岁。因银屑病口服复方青黛丸，每日3次，每次6g，服药23天后，出现乏力、恶心、腹胀、纳差。检查结果显示患者肝功能异常，临床诊断为药物性肝损伤。排除了其他因素后，停用复方青黛丸，肝功能逐步恢复正常。查阅患者病历，患者2年前服用该药20天，也曾出现相同症状。该患者肝功能异常的不良反应与复方青黛丸之间的因果关系应评价为
A. 很可能
B. 可能
C. 可能无关
D. 肯定
E. 无法评价

正确答案：D。肯定

解析：本题考查的是药品不良反应/事件报告表。因银屑病口服复方青黛丸，每日3次，每次6g，服药23天后，出现乏力、恶心、腹胀、纳差。检查结果显示患者肝功能异常，临床诊断为药物性肝损伤。排除了其他因素后，停用复方青黛丸，肝功能逐步恢复正常。查阅患者病历，患者2年前服用该药20天，也曾出现相同症状。该患者肝功能异常的不良反应与复方青黛丸之间的因果关系应评价为肯定（D对）。国家药品监督管理局（NMPA）发布的《药品不良反应报告和监测管理办法》将不良反应与药品的关联程度分为六个级别：肯定、很可能、可能、可能无关、待评价、无法评价。其中待评价和无法评价是指因为资料不足，难以评价不良反应与药品之间的关联性。关联性评价标准：①肯定：用药及反应发生时间顺序合理；停药以后反应停止，或迅速减轻或好转（根据机体免疫状态某些ADR反应可出现在停药数天以后）；再次使用，反应再现，并可能明显加重（即激发试验阳性）；同时有文献资料佐证；并已排除原患疾病等其他混杂因素影响。②很可能（A错）：无重复用药史，余同“肯定”或虽然有合并用药，但基本可排除合并用药导致反应发生的可能性。③可能（B错）：用药与反应发生时间关系密切，同时有文献资料佐证；但引发ADR的药品不止一种，或原患疾病病情进展因素不能除外。④可能无关（C错）：ADR与用药时间相关性不密切，反应表现与已知该药ADR不相吻合，原患疾病发展同样可能有类似的临床表现。⑤待评价：报表内容填写不齐全，等待补充后再评价，或因果关系难以定论，缺乏文献资料佐证。⑥无法评价（E错）：报表缺项太多，因果关系难以定论，资料又无法补充。